在线粒体中进行的代谢过程是
A. 脂肪酸合成
B. 糖酵解
C. 糖原合成
D. 氧化磷酸化
E. 核糖体循环

正确答案：D。氧化磷酸化